红霉素用于
A. 支原体肺炎
B. 立克次体病
C. 螺旋体病
D. 恙虫病
E. 鼠疫

正确答案：A。支原体肺炎